A型行为性格与下列疾病有关
A. 溃疡病
B. 风心病
C. 冠心病
D. 癌症
E. 神经症

正确答案：C。冠心病

解析：1950年美国心脏病专家Friedman和Rosenman发现CHD（冠心病）（C对）患者大都有较高的成就欲望，富于挑战和竞争精神，容易发生无端敌意，争强好胜，不耐烦，有时间紧迫感，Friedman称其为“AIAI反应”，即A型行为模式。溃疡病（A错）与应激有关，癌症（D错）与C型行为有关，风心病（B错）与乙型溶血性链球菌感染有关，神经症（E错）通常与不良的社会心理因素有关。